保和丸的组成药物中含有
A. 陈皮、甘草
B. 茯苓、白术
C. 半夏、生姜
D. 神曲、银花
E. 山楂、连翘

正确答案：E。山楂、连翘

解析：本题考查保和丸的药物组成。保和丸为消食剂，由山楂（焦），六神曲（炒），半夏（制），茯苓，陈皮，连翘，莱菔子（炒）组成（E对）。记忆：保和神曲与山楂，苓夏陈翘菔子加，炊饼为丸白汤下，消食和胃效堪夸。